多见于儿童及青少年，患牙有较大的穿髓孔，根尖孔粗大，牙髓血运丰富，牙髓组织经过穿髓孔突出生长，称为
A. 慢性闭锁性牙髓炎
B. 慢性溃疡性牙髓炎
C. 深龋洞
D. 牙周膜息肉
E. 牙髓息肉

正确答案：E。牙髓息肉

解析：本题考查慢性牙髓炎。多见于儿童及青少年，患牙有较大的穿髓孔，根尖孔粗大，牙髓血运丰富，牙髓组织经过穿髓孔突出生长，称为牙髓息肉（E对）。慢性增生性牙髓炎多见于儿童及青少年，患牙有较大的穿髓孔，根尖孔粗大，牙髓血运丰富，使炎性牙髓组织增生成息肉状经穿髓孔突出，又称为牙髓息肉。